生产经营用于传染病防治的消毒产品，须经以下哪个部门的审批
A. 县级以上人民政府
B. 市级以上人民政府卫生行政部门
C. 市级以上人民政府
D. 省级以上人民政府卫生行政部门
E. 省级以上人民政府

正确答案：D。省级以上人民政府卫生行政部门

解析：生产用于传染病防治的消毒产品的单位和生产用于传染病防治的消毒产品，应当经省级以上人民政府卫生行政部门（D对）审批。